张口时，下颌偏向左侧，考虑损伤神经为
A. 左侧面神经
B. 右侧面神经
C. 右上颌神经
D. 右下颌神经
E. 左下颌神经

正确答案：E。左下颌神经

解析：下颌神经含三叉神经运动纤维，支配翼内肌、翼外肌等。翼内、外肌的功能是将下颌推向前下。因而张口时，下颌偏向左侧，考虑损伤神经为左下颌神经(E对D错)。面神经（AB错）的功能主要为支配面部表情肌运动、泪腺等腺体分泌、舌前2/3味觉。上颌神经（C错）的功能主要为支配睑裂与口裂之间的皮肤、口鼻腔黏膜等感觉。